下列哪种功能，淋巴结不具备
A. 是淋巴器官
B. 产生淋巴细胞
C. 是免疫器官
D. 滤过淋巴
E. .贮血

正确答案：E。.贮血

解析：淋巴器官包括淋巴结（A对)，可以产生淋巴细胞(B对），参与机体的免疫反应，滤过淋巴（D对），是免疫器官（C对），脾具有贮血功能而淋巴结不具备贮血功能（E错）。